27岁的糖尿病患者，极度消瘦，曾有过酮症酸中毒病史，血糖波动大。治疗应首选
A. 饮食疗法
B. 饮食疗法+运动治疗
C. 饮食疗法+短效胰岛素
D. 饮食疗法+长效胰岛素
E. 饮食疗法+二甲双胍

正确答案：D。饮食疗法+长效胰岛素

解析：27岁的糖尿病患者，极度消瘦，为1型糖尿病，曾有过酮症酸中毒病史，血糖波动大，故应使用长效胰岛素（D对）来治疗，饮食疗法是重要的基础治疗措施，其目的是维持标准体重，纠正已发生的代谢紊乱，减轻胰岛负担，使胰岛细胞功能获得恢复的机会，达到既保证血糖的控制，又不降低病人生活质量和工作能力的标准。饮食治疗（A错）、运动治疗（B错）不能有效地降低血糖，短效胰岛素（C错）、二甲双胍（E错）均不能较好的控制波动幅度大的血糖。